嗜酸性淋巴肉芽肿不能累及的组织是
A. 皮肤
B. 肌肉
C. 腺体
D. 黏膜
E. 皮下组织

正确答案：D。黏膜

解析：嗜酸性淋巴肉芽肿可累及皮肤、皮下组织，深者累及肌肉、淋巴结和腺体。掌握“血管瘤及嗜酸性淋巴肉芽肿”知识点。